正确描述肱动脉的是
A. 行经桡神经沟
B. 与肌皮神经伴行
C. 与尺神经伴行
D. 与正中神经伴行
E. 沿肱二头肌外侧沟下行

正确答案：D。与正中神经伴行

解析：肱动脉与正中神经伴行（D对）沿肱二头肌的内侧（E错）至肘窝，在平桡骨颈的高度分为桡动脉和尺动脉。